根据《中华人民共和国药品管理法实施条例》，医疗机构因临床急需进口少量药品，应向国家药品监督管理部门提出申请，并持有
A. 《药品生产许可证》
B. 《进口药品注册证》
C. 《医疗产品注册证》
D. 《医疗机构执业许可证》
E. 《医药产品许可证》

正确答案：D。《医疗机构执业许可证》

解析：本题考查药品管理。医疗机构因临床急需进口少量药品的，应当持《医疗机构执业许可证》（D对）向国务院药品监督管理部门提出申请，经批准后，方可进口。